男，59岁，进食哽噎1月余，症状逐渐加重。近半年来左胸痛，服用“救心丸”无改善。为明确诊断，首选的检查是
A. 胸部MRI
B. 超声心电图
C. 胃镜
D. 心电图
E. 胸部CT

正确答案：C。胃镜

解析：中老年患者，进食哽噎，症状逐渐加重（提示为进行性吞咽困难），左胸痛服用“救心丸”无改善（提示非心脏疾病引起的胸痛），结合患者病史和临床表现，该患者最可能的诊断为食管癌。为明确诊断，首选的检查是胃镜（C对），胃镜下可取活检行病理组织学检查，此为食管癌诊断的金标准。胸部MRI（A错）和胸部CT（E错）均为影像学检查方法，可辅助诊断食管癌，但不能确诊。超声心电图（B错）及心电图（D错）主要用于心脏病变的检查，该患者胸痛与心脏无关，故这两项检查对该患者意义不大。